患者，女，72岁。绝经23年，子宫萎缩，Ⅲ度脱垂，伴有冠心病。应首选的治疗
A. 补中益气汤
B. 阴道子宫全切术及阴道前后壁修补术
C. 子宫托
D. 阴道纵隔形成术
E. 针灸治疗

正确答案：D。阴道纵隔形成术

解析：阴道纵膈形成术又称阴道封闭术或Le Fort手术，适用于年老体弱不能耐受较大手术，不需要保留性交功能者（D对）。补中益气汤（A错）适用于子宫脱垂的中气下陷证，证见阴中有物突出，劳则加剧，卧则回纳，小腹下坠，身倦乏力，少气懒言，或面色无华，舌淡，苔薄，脉缓弱。阴式子宫全切除及阴道前后壁修补术（B错）适用于Ⅱ、Ⅲ度子宫脱垂伴阴道前、后壁脱垂，年龄较大无生育要求且无手术禁忌症者。子宫托（C错）是使子宫和阴道壁维持在阴道内而不突出的工具，适用于各度子宫脱垂和阴道前后壁脱垂，但重度子宫脱垂伴盆底肌明显萎缩以及宫颈或阴道壁有炎症和溃疡者均不宜使用。针灸疗法（E错）取关元、肾俞、足三里、三阴交等穴位，用毫针刺入，点燃艾条温灼针身和针刺穴位，时间以患者耐受程度和病势轻重而定。